下列精神分裂症状中，属于阳性症状的是
A. 思维贫乏
B. 病理性象征性思维
C. 情感淡漠
D. 意志减退
E. 情感平淡

正确答案：B。病理性象征性思维

解析：此试题是理解判断题，考查考生对精神分裂症阳性症状的理解。精神分裂症阳性症状是指正常心理功能的偏移，涉及感知、思维、情感、意志和行为等方面。阴性症状是指正常心理功能的缺失所表现出来的各种障碍，思维贫乏、情感平淡、情感淡漠和意志减退分别是正常思维、情感和意志活动的减弱或缺乏，属于精神分裂症的阴性症状。只有病理性象征性思维是正常人的象征性思维的偏移，患者的象征性思维偏离了正常人的思维逻辑和习惯，使正常人很难理解患者的象征性思维的含义，成为病理性象征性思维，属于精神分裂症的阳性症状，故答案是B。思维贫乏（A错）、情感淡漠（C错）、意志减退（D错）、情感平淡（E错）均属于精神分裂症的阴性症状而不是阳性症状。